女，56岁。下腹不适、腹胀半年，发现腹部包块1个月。3年前行胃癌根治术，病理为胃窦部腺癌。妇科检查：外阴、阴道正常，宫颈光滑，萎缩，子宫正常大小，双侧附件区各触及一个约8cm×6cm×5cm大小的椭圆形包块，移动性浊音（－）。最可能的诊断是
A. 库肯勃瘤
B. 卵巢上皮性癌
C. 卵巢纤维瘤
D. 卵巢无性细胞瘤
E. 卵巢畸胎瘤

正确答案：A。库肯勃瘤

解析：患者3年前行胃癌根治术（原发灶可能），下腹不适、腹胀半年，发现腹部包块1个月，双侧附件区各触及一个约8cm×6cm×5cm大小的椭圆形包块。考虑卵巢转移性肿瘤可能性大，转移性肿瘤中又以库肯勃瘤最为常见（A对）。种植转移是最早提出的一种转移途径，认为原发灶肿瘤细胞可突破浆膜层并脱落到腹腔或腹腔积液中，借助肠蠕动和（或）腹腔积液种植于卵巢表面而浸润生长。患者既往胃癌病史，考虑胃癌转移性肿瘤可能性最大，卵巢上皮性癌（B错）、卵巢纤维瘤（C错）、卵巢无性细胞瘤（D错）、卵巢畸胎瘤（E错）均非卵巢转移性肿瘤。